化学物需耗能方可透过生物膜的转运方式为
A. 易化扩散、滤过
B. 膜动转运、主动转运
C. 简单扩散、滤过
D. 膜动转运、简单扩散
E. 易化扩散、主动转运

正确答案：B。膜动转运、主动转运